正常肺部叩诊音为
A. 鼓音
B. 过清音
C. 浊音
D. 清音
E. 实音

正确答案：D。清音

解析：正常肺部叩诊音为清音（D对）。鼓音（A错）如同击鼓声，在叩击含有大量气体的空腔脏器时出现。正常情况下可见于胃泡区和腹部，病理情况下可见于肺内空洞、气胸、气腹等情况。过清音（B错）介于清音与鼓音之间。临床主要见于肺组织含气量增多、弹性减弱的病变如肺气肿。浊音（C错）音调较高，音响较弱，当叩击被少量含气组织覆盖的实质脏器时产生，如叩击心或肝被肺段边缘所覆盖的部分，或在病理状态下如肺炎（肺组织含气量减少）的叩诊音。实音（E错）音调较浊音更高，音响更弱，振动持续时间更短的一种非乐性音，如叩击心和肝等实质脏器所产生的音响。在病理状态下可见于大量胸腔积液或肺实变等。